既行气导滞，又通阳散结的药是
A. 枳实
B. 佛手
C. 薤白
D. 青皮
E. 柿蒂

正确答案：C。薤白

解析：本题考查的是薤白的功效。既行气导滞，又通阳散结的药是薤白（C对）。薤白：【功效】通阳散结，行气导滞。枳实（A错）：【功效】破气消积，化痰除痞。佛手（B错）：【功效】疏肝理气，和中，化痰。青皮（D错）：【功效】疏肝破气，消积化滞。柿蒂（E错）：【功效】降气止呃。